患者，女，56岁，血清总胆固醇和低密度脂蛋白胆固醇异常，初诊医师建议首先改变生活方式（控制饮食，增强运动）。一个月后复查血脂水平仍未达标，医师处方辛伐他汀片20mg/d治疗。若采用强化治疗，辛伐他汀片的最大日剂量是
A. 20mg
B. 40mg
C. 80mg
D. 100mg
E. 120mg

正确答案：C。80mg

解析：本题考查辛伐他汀的使用。辛伐他汀口服：用于高胆固醇血症，初始剂量一次10～20mg，晚间顿服；用于心血管事件高危人群推荐初始剂量一次20～40mg，晚间顿服，调整剂量应间隔4周以上；用于纯合子家族性高胆固醇血症，推荐一次40mg，晚间顿服；或一日80mg，分早晨20mg、午间20mg和晚间40mg服用；对杂合子家族性高胆固醇血症的儿童（10～17岁），推荐初始剂量一日10mg，晚间顿服。最大剂量为40mg，应按个体化调整剂量。故最大日剂量为80mg（C对）。